最主要来源于动植物体的有机物为
A. 有机氮
B. 蛋白氮
C. 氨氮
D. 亚硝酸盐氮
E. 硝酸盐氮

正确答案：A。有机氮

解析：本题考查含氮化合物的相关内容。含氮化合物包括有机氮、蛋白氮、氨氮、亚硝酸盐氮和硝酸盐氮。有机氮（A对BCDE错）是有机含氮化合物的总称，蛋白氮是指已经分解成较简单的有机氮，此两者主要来源于动植物，如动物粪便、植物遗体腐败、藻类和原生动物等。